判断牙髓活力最可靠的检查方法是
A. 温度测验
B. 电测验
C. 选择性麻醉
D. 试验性备洞
E. X线检查

正确答案：D。试验性备洞

解析：本题考查判断牙髓活力的检查方法。试验性备洞指用牙钻磨除牙本质来判断牙髓活力的方法，机械法刺激牙髓检查牙髓活力，可以避免假阳性和假阴性，是判断牙髓活力最可靠的检查方法（D对）。温度测验如冰棒法测验时，要避免融化的冰水接触牙龈而导致假阳性反应（A错）。电测验存在假阳性和假阴性情况（B错）。选择性麻醉是通过局部麻醉的方法来判定引起疼痛的患牙，当其他诊断方法对两颗可疑患牙不能做出最后鉴别，且两颗牙分别位于上下颌或该两颗牙均在上颌但不相邻时，采用选择性麻醉可确诊患牙，但不能判断牙髓活力（C错）。X线检查是指通过拍摄X线片，对龋病、牙髓病和根尖周病的诊断和治疗进行判断的检查方法，不能判断牙髓活力（E错）。